与获得性免疫缺陷发生无关的因素是
A. 病毒感染
B. 胸腺发育不全
C. 肿瘤放疗和化疗
D. 重度营养不良
E. 长期使用免疫抑制剂

正确答案：B。胸腺发育不全

解析：获得性免疫缺陷病是指后天因素造成的、继发于某些疾病或使用药物后产生的免疫缺陷性疾病。引起获得性免疫缺陷病的常见因素有：1.非感染因素 （1）营养不良（D对），是引起免疫缺陷病最常见的因素；（2）恶性肿瘤，免疫系统肿瘤可进行性损伤患者免疫系统，导致患者免疫功能障碍；（3）医源性免疫缺陷，长期使用免疫抑制剂（E对）或者肿瘤放疗和化疗（C对），均可引起免疫缺陷。2.感染：某些病毒感染（A对）、细菌、寄生虫感染等，均可不同程度的影响机体免疫系统，导致获得性免疫缺陷。胸腺是T细胞分化、成熟的场所，胸腺发育不全（B错，为本题正确答案）引起原发性T细胞缺陷，属于原发性免疫缺陷病，与获得性免疫缺陷无关。